可摘局部义齿三种支持形式中，哪一描述是错误的
A. 主要由天然牙来承担（牙合）力的称牙支持式
B. 牙支持式多用于缺牙数目不多而基牙健康者
C. 黏膜支持式义齿多用三臂卡增加固位，减轻黏膜负担
D. 混合支持式义齿尤其适用于游离缺失的牙列缺损
E. 混合支持式义齿是由天然牙和黏膜共同承担（牙合）力

正确答案：C。黏膜支持式义齿多用三臂卡增加固位，减轻黏膜负担

解析：可摘局部义齿按义齿的支持组织不同，可分为以下三种类型：牙支持式义齿两端基牙上均放置支托和卡环，义齿的力主要由天然牙承担。适用于少数牙缺失，或缺牙间隙小，缺隙两端均有基牙，且基牙稳固者。黏膜支持式义齿仅由基托和人工牙及无支托的卡环组成。力通过基托直接传递到黏膜和牙槽骨上。适用于多数牙缺失，余留牙松动，或因咬合过紧无法磨出支托位置者。混合支持式义齿基牙上有支托和卡环。基托有足够的伸展，由天然牙和黏膜共同承担力。适用于各类牙列缺损，尤其是游离端缺失者。掌握“局部义齿类型，肯氏分类及模型观测”知识点。